男，70岁，70%烧伤第2日，收缩压：80mmHg，呼吸率34次/分，每小时平均尿量18ml，有黑色大便，血胆红素36μmol/L，血小板40×10⁹/L，Glasgow计分：5分，目前最恰当的诊断是
A. ARDS
B. ARF
C. DIC
D. ATN
E. MSOF

正确答案：E。MSOF

解析：该患者为老年男性，特重烧伤（烧伤总面积50%以上即为特重烧伤），休克（通常认为收缩压＜90mmHg是休克存在的表现），呼吸过速（呼吸频率超过20次/分），尿量偏少，黑便（提示发生过消化道出血），血胆红素升高（正常值为3.4～17.1μmol/L，34.2～171μmol/L为轻度黄疸，提示发生溶血或肝功能受损），血小板低（正常值为100～300×10⁹/L），Glasgow计分：5分提示病情严重（Glasgow昏迷评分为3～15分，一般5分以下为病情极严重，而9分以上者的病情较轻，详见七版黄家驷外科学P435）。综上，患者多器官功能障碍，目前最恰当的诊断为MSOF，即多器官功能衰竭（在临床上等同于MODS）（E对）。多器官功能衰竭（九版内科学P146）指机体在遭受急性严重感染、严重创伤、大面积烧伤等突然打击后，同时或先后出现2个或2个以上器官功能障碍。ARDS（九版内科学P130）（A错），即急性呼吸窘迫综合征，是指各种肺内和肺外致病因素所导致的急性弥漫性肺损伤和进而发展的急性呼吸衰竭，主要表现为呼吸窘迫、顽固性低氧血症和呼吸衰竭，肺部影像学表现为双肺渗出性病变。ARF（九版内科学P509）（B错），即急性肾衰竭，是指由多种病因引起的肾功能快速下降而出现的临床综合征，虽也可出现多器官功能受损，但以少尿、无尿、肾小球滤过率下降为突要表现。DIC（九版内科学P623）（C错），即弥漫性血管内凝血，表现为出血倾向、休克或微循环衰竭、溶血等。ATN（D错）即急性肾小管坏死，是由肾缺血或肾毒性物质损伤肾小管上皮细胞引起的，主要表现为少尿、无尿、肾功能下降。